女性，31岁。上腹痛2年，疼痛发作与情绪、饮食有关，查体：上腹部轻压痛，胃镜胃窦皱襞平坦，可见黏膜下血管分布，此病例可诊断为
A. 消化性溃疡
B. 胃黏膜脱垂症
C. 慢性非萎缩性胃炎
D. 胃癌
E. 慢性萎缩性胃炎

正确答案：E。慢性萎缩性胃炎

解析：中年女性患者，有上腹痛两年病史，胃镜表现为胃窦皱襞平坦，可见黏膜下血管分布（慢性萎缩性胃炎的典型表现），诊断为慢性萎缩性胃炎（E对）。消化性溃疡（P359）（A错）表现为周期性上腹痛，胃镜表现为边缘光滑，底部由肉芽组织构成，覆以灰黄色渗出物，周围黏膜常有炎症水肿。胃黏膜脱垂症（B错）胃镜下可见胃窦黏膜正常或呈点状充血、水肿，当胃窦收缩时，黏膜皱襞非常明显，可形成菊花状，掩盖幽门口，当胃窦松弛时，可见到脱入十二指肠的皱襞经幽门管向胃腔内反涌过来。慢性非萎缩性胃炎（P354）（C错）胃镜表现为红黄相间，黏膜皱襞增粗。胃癌（P365）（D错）胃镜表现为肿瘤表面凹凸不平，糜烂，有污秽苔，也可呈深大溃疡。